下列哪项是性传播疾病最危险的传染源
A. 典型病人
B. 症状不典型的病人
C. 吸毒者
D. 供血者
E. 性乱者

正确答案：B。症状不典型的病人

解析：本题考查性传播疾病的传染源。性传播疾病的传染源中症状不典型的病人（B对ACDE错）是性传播疾病的最主要传播途径，因为无典型症状会造成部分人漏诊、漏治，从而扩大流行范围，增加治疗难度。